某地土壤受镉污染后，用石灰处理可以显著降低糙米镉的含量，其原理是
A. 形成镉螯合物
B. 改变镉的价态
C. 形成难溶性氢氧化物沉淀
D. 提高土壤对镉的吸附率
E. 使镉成为易溶于水的化合物

正确答案：C。形成难溶性氢氧化物沉淀

解析：本题考查石灰降低糙米镉含量的原理。土壤受镉污染后，用石灰调节土壤pH可明显降低糙米中的镉含量，其原理是：当土壤pH偏碱性时，镉离子形成难溶的氢氧化物而沉淀（C对ABDE错），糙米难以吸收。